下列不是二次研究证据的是
A. 系统评价
B. 证据概要
C. 综合证据
D. 随机对照试验
E. 临床实践指南

正确答案：D。随机对照试验

解析：本题考查二次研究证据的分类。二次研究证据是指尽可能全面收集某一问题的全部原始研究证据，进行严格评价、整合、分析、总结所得出的综合结论，是对多个原始研究证据再加工后得到的证据。系统评价（A对）、证据概要（B对）、综合证据（C对）和临床实践指南（E对）均属于二次研究证据。随机对照实验（D错，为本题正确答案）不属于二次研究证据。